常致反射性心动过速
A. 卡托普利
B. 硝苯地平
C. 氢氯噻嗪
D. 氨苯蝶啶
E. 美托洛尔

正确答案：B。硝苯地平

解析：硝苯地平（B对）为L型钙通道阻滞剂，对窦房结的T型钙通道无作用，所以可对窦房结的负性频率作用较小，但可明显扩张外周血管而降低血压，从而兴奋减压反射，反射性引起心动过速。美托洛尔（E错）是选择性β₁受体阻断药，对心脏有全面抑制作用，可使心率减慢而引起心动过缓。卡托普利、氢氯噻嗪、氨苯蝶啶对心率无明显影响（ACD错）。